关于流行性乙型脑炎病毒，哪项是错误的
A. 蚊是传播媒介
B. 猪是扩增宿主
C. 多为隐性感染
D. 为DNA病毒
E. 病毒外层有包膜

正确答案：D。为DNA病毒